医生行使干涉权不是针对
A. 拒绝治疗的住院精神病患者
B. 要求易诊的患者
C. 需要隔离而拒绝隔离的传染病患者
D. 有意扰乱正常医疗秩序的患者
E. 实施自杀行为的抑郁症患者

正确答案：B。要求易诊的患者